停经5周，子宫稍大，软，附件可触及包块，妊娠试验阳性，清宫术中宫腔吸出物约5g，下沉于水中，当晚突然下腹撕裂样痛，肛门坠胀感，血压下降，诊断是
A. 子宫内膜炎
B. 子宫穿孔
C. 血液流入腹腔
D. 子宫颈管裂伤
E. 输卵管妊娠破裂

正确答案：E。输卵管妊娠破裂

解析：宫腔吸出物约5g，下沉于水中，提示没有绒毛膜，可以排除宫腔内妊娠。吸出物可以沉水说明是蜕膜，没有绒毛。故诊断为异位妊娠。子宫穿孔是人工流产操作中的并发症，题干中没有相关提示，故排除。掌握“异位妊娠”知识点。